细胞内液中的主要阳离子是
A. Na⁺
B. Mg²⁺
C. Ca²⁺
D. K⁺
E. Fe²⁺

正确答案：D。K⁺

解析：细胞内液中的主要阳离子是K⁺（D对），其次是 Na＋（A错）、Ca2+（C错）、Mg2+（B错）。主要阴离子是HPO₄²⁻和蛋白质，其次是HCO₃⁻、CL⁻、SO₄²⁻等。